患者女性，25岁，误服敌敌畏10ml半小时后昏迷来院，诊断急性有机磷中毒。下列属于烟碱样症状的是
A. 肌纤维束颤动
B. 多汗
C. 肺水肿
D. 瞳孔缩小
E. 流涎

正确答案：A。肌纤维束颤动